巨大胎儿经阴道分娩的常见并发症不包括
A. 产程延长
B. 产后出血
C. 肩难产
D. 头盆不称
E. 羊水栓塞

正确答案：E。羊水栓塞

解析：巨大胎儿对母体的影响主要有：（1）头盆不称发生率上升（D对），增加剖宫产率；（2）阴道分娩主要危险是肩难产（C对），其发生率与胎儿体重成正比；（3）肩难产处理不当可造成子宫过度扩张，易发生子宫收缩乏力、产程延长（A对），易导致产后出血（B对）。羊水栓塞多见于高龄初产妇和多产妇（较易发生子宫损伤）、自发或人为导致的宫缩过强、急产、胎膜早破、前置胎盘、胎盘早剥、子宫不完全破裂、剖宫产术等，巨大胎儿经阴道分娩的常见并发症不包括羊水栓塞（E错，为本题正确答案）。